一个tRNA反密码子为5′-IGC-3′，它可以识别的密码
A. 5′-GCA-3′
B. 5′-GCG-3′
C. 5′-CCG-3′
D. 5′-ACG-3′
E. 5′-UCG-3′

正确答案：A。5′-GCA-3′